女性，25岁，左上唇鼻翼旁毛囊炎致形成疖肿，已有脓头形成，自行挤压排脓后2日，开始出现头痛、高热，初步判断感染向颅内扩散，并发海绵窦血栓性静脉炎，其扩散途径通常是
A. 面前静脉、颈内静脉
B. 颞浅静脉、内眦静脉
C. 眶内静脉、面前静脉
D. 内眦静脉、眼静脉
E. 面前静脉、内眦静脉、眼静脉

正确答案：E。面前静脉、内眦静脉、眼静脉

解析：本题考查面部感染的扩散途径。患者女，左上唇鼻翼旁（危险三角区）毛囊炎致形成疖肿，已有脓头形成，自行挤压排脓后2日（处理不当），开始出现头痛、高热，初步判断感染向颅内扩散，并发海绵窦血栓性静脉炎，其扩散途径通常是面前静脉、内眦静脉、眼静脉（E对），此处为面部“危险三角区”，静脉瓣皆成袋状，袋口呈向心性开放，静脉有瓣但又不能完全阻止血液反流，当面部发生化脓性感染时，感染源由此路径逆流至颅内的海绵窦，从而导致海绵窦血栓性静脉炎。内眦静脉、眼静脉（D错）应与面前静脉三者结合才是完整的扩散途径。面前静脉、颈内静脉（A错）中颈内静脉始于颅底的颈静脉孔，为颅内乙状窦直接向下的延续，不属于此面部感染的扩散途径。颞浅静脉、内眦静脉（B错）中颞浅静脉位于颞部皮下，外耳门的前方，起始于头皮广泛分布的静脉网，不属于此面部感染的扩散途径。眶内静脉、面前静脉（C错）中眶内静脉不符合面部静脉的分类。